患者，女，27岁，孕32周，因尿急、尿痛就诊，诊断为尿路感染，应选用的药物是
A. 复方磺胺甲噁唑片
B. 莫西沙星片
C. 阿莫西林胶囊
D. 阿奇霉素片
E. 米诺环素片

正确答案：C。阿莫西林胶囊

解析：本题考查阿莫西林。应选用的药物是阿莫西林胶囊（C对）。妊娠期尿路感染时的选药原则为：①宜选用毒性小的抗菌药物，如阿莫西林、呋喃妥因或头孢菌素类等。②孕妇的急性膀胱炎治疗时间为3～7日。③孕妇急性肾盂肾炎应静脉滴注抗菌药物治疗，疗程两周。可用半合成广谱青霉素（氨苄西林）或第三代头孢菌素（头孢曲松钠、头孢噻肟）。复方磺胺甲噁唑片（A错）可作为急性膀胱炎的短程疗法。莫西沙星片（B错）用于治疗成人（≥18岁）敏感细菌所引起的感染。阿奇霉素片（D错）用于敏感细菌所引起支气管炎、肺炎、急性中耳炎、鼻窦炎、咽炎、扁桃体炎、皮肤和软组织感染等。米诺环素片（E错）用于敏感菌引起的各类疾病，如败血症、梅毒、尿道炎、支气管炎等。